男孩，2岁。低热15天，伴盗汗消瘦轻咳10天。胸部X线透视呈“双极影”，诊断为原发综合征。不符合活动性肺结核的指标是
A. 结核菌素试验硬结直径≥15mm
B. 有发热及其他结核中毒症状
C. 胃液找到抗酸杆菌
D. 胸部X线片示渗出性改变
E. 血沉增快，而无其他原因解释

正确答案：C。胃液找到抗酸杆菌

解析：胃液找到抗酸杆菌是诊断胃炎时的一种临床检查方法，不符合活动性肺结核的诊断指标（C错，为本题正确答案）。活动性肺结核可出现结核菌素试验硬结直径≥15mm（A对）、有发热及其他结核中毒症状（B对）、胸部X线片示渗出性改变（D对）、血沉增快，而无其他原因解释（E对）。